哪个牙的形态不似任何恒牙
A. 上颌乳尖牙
B. 下颌乳尖牙
C. 上颌乳中切牙
D. 上颌第二乳磨牙
E. 下颌第一乳磨牙

正确答案：E。下颌第一乳磨牙

解析：下颌第一乳磨牙是唯独不类似任何恒牙的乳牙。掌握“上下颌前牙的外形及临床应用解剖”知识点。